六味安消散除和胃健脾、消积导滞外，又能
A. 降气止呕
B. 活血止痛
C. 理气消肿
D. 清利湿热
E. 疏肝散结

正确答案：B。活血止痛

解析：本题考查的是六味安消散的功能。六味安消散除和胃健脾、消积导滞外，又能活血止痛（B对）。六味安消散：【功能】和胃健脾，消积导滞，活血止痛。旋覆花：【功效】消痰行水，降气止呕（A错）。枳实导滞丸：【功能】消积导滞，清利湿热（D错）。蒲公英：【性能特点】本品苦寒清泄，甘淡渗利，入肝、胃经。药食兼用，既善清热解毒，又兼疏肝通乳、散结（E错）消痈，还能利尿、缓通大便，导湿热、热毒从二便而出。力强效佳而味不甚苦，为治疮肿良药。虽内、外痈皆宜，但以外痈为主，乳痈尤佳，内服外用皆效，并治火毒咽痛、目赤及湿热黄疸、淋痛。功能为理气消肿（C错）的中成药，2022年考试指南未明确说明。